患者，男，32岁，在背部皮下发现直径为0.5～1.5cm大小的结节，约有30个，结节为圆形，硬度似软骨，无压痛，活动度好，3个月后又发生头痛、癫痫，该患者可能患的是
A. 猪带绦虫病
B. 牛带绦虫病
C. 囊尾蚴病
D. 棘球蚴病
E. 微小膜壳绦虫病

正确答案：C。囊尾蚴病